异烟肼胖+链霉素+对氨基水杨酸盐，合并用药的目的是
A. 提高药物疗效
B. 减少不良反应
C. 治疗多种疾病
D. 延缓细菌耐药
E. 减少经济负担

正确答案：D。延缓细菌耐药